错误的是
A. 位于两侧大脑半球和中脑之间
B. 两侧间脑之间有第三脑室
C. 视觉传入纤维连于间脑
D. 外侧膝状体,内侧膝状体和松果体等均属间脑
E. 嗅神经连于间脑

正确答案：E。嗅神经连于间脑

解析：间脑位于两侧大脑半球和中脑之间（A对），包括背侧丘脑、后丘脑、上丘脑、底丘脑和下丘脑等5个部分，两侧间脑之间有一窄腔为第三脑室（B对）。间脑中的后丘脑包括内侧膝状体和外侧膝状体，其中外侧膝状体为视觉传导通路的中继站，接受视束的传入纤维（C对）。间脑中的上丘脑包括松果体（D对），16岁以后松果体逐渐钙化。嗅神经接受嗅觉冲动后，穿过筛板的筛孔和硬脑膜达颅前窝，终止于嗅球。嗅球发出纤维再经嗅束、外侧嗅纹而终止于大脑的嗅中枢，因而嗅神经与间脑不相连（E错，为本题正确答案）。